结核杆菌是导致肺结核的
A. 充分病因
B. 必要病因
C. 两者均是
D. 两者均否

正确答案：B。必要病因

解析：本题考查必要病因。必要病因是一个疾病发生必需的组分病因，是该疾病所有充分病因都需要的组分病因；若该病因不存在，疾病就不会发生，因此所有病人都具有该病因。结核杆菌是导致肺结核的必要病因（B对ACD错），如果结核杆菌不存在则就不会导致肺结核。